香砂枳术丸的功能是
A. 开胃消食，润肠通便
B. 行气化湿，健脾和胃
C. 健脾开胃，行气消胀
D. 温中散寒，消食化积
E. 解表祛风，健胃消食

正确答案：C。健脾开胃，行气消胀